内皮细胞受损，启动内源性凝血途径是通过活化
A. 凝血酶原
B. 纤维蛋白原
C. 钙离子
D. XⅡ因子
E. 组织因子

正确答案：D。XⅡ因子

解析：内皮细胞受损，启动内源性凝血途径是通过活化XⅡ因子（D对ABCE错）开始的，当血液与带负电荷的异物表面（如胶原）接触时，FXII被激活为FXIla,接着再激活FXI为FXla,从而启动内源性凝血途径。